下列对队列研究与病例对照研究描述错误的是
A. 都不需要给予人为干预
B. 病例对照研究比队列研究省时、省力
C. 都是分析性研究方法
D. 队列研究验证病因假设的能力较病例对照研究强
E. 都可以计算发病密度

正确答案：E。都可以计算发病密度

解析：本题考查队列研究与病例对照研究的比较。队列研究和病例对照研究都属于分析性研究（C对），都不需要给予人为干预（A对）；病例对照研究比队列研究省时、省力（B对）；队列研究验证病因假设的能力较病例对照研究强（D对）；队列研究可以计算发病密度而病例对照研究不能计算发病密度（E错，为本题正确答案）。